导致胎儿生长受限最常见的病因是
A. 胎盘早剥
B. 臀先露
C. 前置胎盘
D. 重度子痫前期
E. 高龄初产

正确答案：D。重度子痫前期

解析：胎儿生长受限约与以下因素有关（实用妇产科学第2版P250-P251）：1. 孕妇因素，其中子宫胎盘血流灌注不良引起的胎儿生长受限占1/3，包括妊娠高血压综合征（D对）、慢性肾炎、高血压；2. 胎儿因素，如多胎妊娠、染色体畸变等；3. 胎盘因素，如胎盘早剥（A错）、前置胎盘（C错）引起的胎儿生长仅受限占1%。臀先露（B错）时会引起胎盘受压和胎膜早破，影响胎盘转运，从而影响胎儿生长，不常见。高龄初产（E错）对胎儿生长影响不大。